三月龄以下婴儿患化脓性脑膜炎，其主要的特点是
A. 缺乏典型症状
B. 强直-阵挛性惊厥
C. 喷射性剧烈呕吐
D. 脑膜刺激征阳性
E. 高热

正确答案：A。缺乏典型症状

解析：三个月以下婴儿患化脓性脑膜炎缺乏典型症状（A对），应注意辨识。